急性高原病分为
A. 急性高原反应、高原肺水肿
B. 急性高原反应、高原脑水肿
C. 高原性心脏病、高原高血压
D. 高原反应、高原肺水肿、高原脑水肿和视网膜出血
E. 高原红细胞增多症、高原脑水肿

正确答案：D。高原反应、高原肺水肿、高原脑水肿和视网膜出血